某病早期治疗效果好，若漏诊后加重，对此病的诊断试验应特别注重
A. 提高阴性预测值
B. 提高阳性预测值
C. 降低假阳性率
D. 提高特异度
E. 提高灵敏度

正确答案：E。提高灵敏度

解析：灵敏度是指金标准确诊的病例中待评价试验也判断为阳性者所占的百分比，此病目前有较可靠的治疗方法，且漏诊的后果严重，应尽可能地发现可疑病人，要求此筛检试验测试真正的病人表现阳性的人数尽可能多，即提高筛选方法的灵敏度（E对）。提高阴性预测值可以使诊断试验排除受检者患病的可能性增加，提高阳性预测值，当试验结果为阳性时，其患病可能性增加，预测值反映的是诊断试验收益的指标，不能直接使漏诊的人数减少（AB错）。假阳性率即误诊率，降低可以使诊断试验误诊的人数降低（C错）。提高特异度使得非病人筛检试验表现阴性的人数增多（D错）。